参与联合脱氨基的酶是
A. NADH-泛醌还原酶
B. HMGCoA还原酶
C. 葡萄糖-6-磷酸酶
D. 谷氨酸脱氢酶
E. 丙酮酸脱氢酶

正确答案：D。谷氨酸脱氢酶

解析：转氨基作用与谷氨酸脱氢作用的结合称为联合脱氨基作用。转氨基作用是α-氨基酸在转氨酶的作用下与α-酮戊二酸反应生成谷氨酸；脱氨基作用是L-谷氨酸在L-谷氨酸脱氢酶（D对）的作用下脱下氨基生成α-酮戊二酸。NADH-泛醌还原酶（P176）（A错）参与生物氧化过程，HMG-CoA还原酶（P164）（B错）是胆固醇合成的关键酶，丙酮酸脱氢酶（P118）（E错）催化的是丙酮酸生成乙酰CoA。